注射剂的优点有
A. 药效迅速、剂量准确、作用可靠
B. 适用于不宜口服的药物
C. 适用于不能口服给药的病人
D. 可迅速终止药物作用
E. 可以产生定向作用

正确答案：A、B、C、E。药效迅速、剂量准确、作用可靠；适用于不宜口服的药物；适用于不能口服给药的病人；可以产生定向作用

解析：本题考查注射剂的优点。注射剂的特点（1）药效迅速、剂量准确、作用可靠（A对）。（2）可适用于不宜口服给药的患者（C对）和不宜口服的药物（B对）。（3）可发挥局部定位作用（E对）。但注射给药不方便，注射时易引起疼痛。(4)易发生交叉污染，安全性不及口服制剂。(5)制造过程复杂，对生产的环境及设备要求高，生产费用较大，价格较高。注射剂药效迅速，药物进入机体后不能迅速终止药物作用（E错）。